关于影响药物透皮吸收因素的说法，错误的是
A. 可增加皮肤水合作用的基质不利于药物吸收
B. 皮肤破损时药物吸收的速度和程度显著增加
C. 皮肤温度升高可加速药物吸收
D. 既有脂溶性又有水溶性的易于吸收
E. 基质pH小于弱酸性药物的pKₐ时有利于药物吸收

正确答案：A。可增加皮肤水合作用的基质不利于药物吸收

解析：本题考查的是影响药物透皮吸收的因素。增加皮肤的水合作用的基质，能增加药物的渗透性（A错，为本题正确答案）。影响外用膏剂中药物透皮吸收的因素：（1）皮肤条件：①应用部位：皮肤的厚薄、毛孔的多少等与药物的穿透、吸收均有关系。不同年龄和性别，由于皮肤条件不同，对药物的穿透、吸收影响也不同。②皮肤的病变：皮肤烧伤、溃疡破损时，药物可自由地进入真皮，吸收的速度和程度大大增加（B对），但可能引起疼痛、过敏及中毒等不良反应。某些皮肤病使角质层致密硬化，则不利于药物的透过。③皮肤的温度与湿度：皮肤温度提高，皮下血管扩张，血流量增加，可加速吸收（C对）。皮肤湿度大，有利于角质层的水合作用，致角质层肿胀，细胞间疏松，有利于吸收。④皮肤的清洁：洗涤可除去部分角质层以及毛囊、皮脂腺上的堵塞物，有利于药物的透过。（2）药物性质：皮肤细胞膜具有类脂质特性，一般脂溶性药物比水溶性药物易穿透皮肤，而组织液是极性的，因此，具有适宜的油、水分配系数，既有一定脂溶性又有一定水溶性的药物透皮吸收较理想（D对）。在油和水中都难溶的药则很难透皮吸收。强亲油性药物可能聚积在角质层表面而难以透过，通常，药物相对分子质量愈大，经皮吸收愈慢，故经皮吸收制剂宜选用相对分子质量较小，药理作用强的药物。（3）基质的组成与性质：①基质组成、类型和性质：直接影响药物的释放、穿透和吸收。一般认为药物的吸收在乳状液型基质中最好，在吸水性软膏基质（凡士林加羊毛脂）、硅酮及豚脂中次之，在烃类基质中最差。若基质的组成与皮脂分泌物类似，则利于某些药物透过皮肤。水溶性基质聚乙二醇对药物的释放较快，但对药物的穿透作用影响不大，制成的软膏较难透皮吸收。②基质的pH：影响酸性和碱性药物的吸收。当基质pH小于弱酸性药物的pKₐ或大于弱碱性药物的pKₐ时，药物的分子型显著增加而利于吸收（E对）。③附加剂：基质中添加表面活性剂、透皮促进剂（如月桂氮酮）等能增加药物的穿透性，有利于吸收。④基质对皮肤的水合作用：增加皮肤的水合作用的基质，能增加药物的渗透性。其中油脂性基质封闭性强，可显著增加皮肤的水合作用。（4）其他因素：药物的透皮吸收除上述影响因素外，还与药物浓度、应用面积、应用次数及与皮肤接触时间等密切相关。